尿路感染脾肾亏虚，湿热屡犯证的治法是
A. 健脾补肾
B. 健脾补肺，利水消肿
C. 健脾补肾，清热通淋
D. 滋阴益肾，清热通淋
E. 益气扶正，利水消肿

正确答案：C。健脾补肾，清热通淋

解析：尿路感染脾肾亏虚，治疗应健脾补肾；湿热屡犯，治疗应清热利湿；病尿路感染，应该通淋；故治法为健脾补肾，清热通淋（C对）。健脾补肾是脾肾两虚证的治法（A错）。健脾补肺，利水消肿是急性肾小球肾炎肺脾不足，水湿停滞证的治法（B错）。滋阴益肾，清热通淋是肾阴不足，水湿停滞的治法（D错）。益气扶正，利水消肿是肺肾不足，水湿停滞的治法（E错）。